马兜铃的功效有
A. 清肺化痰
B. 止咳平喘
C. 和胃降逆
D. 散结消痈
E. 清肠疗痔

正确答案：A、B、E。清肺化痰；止咳平喘；清肠疗痔

解析：本题考查的是马兜铃的功效。马兜铃的功效有清肺化痰（A对）、止咳平喘（B对）与清肠疗痔（E对）。马兜铃：【功效】清肺化痰，止咳平喘，清肠疗痔。枇杷叶：【功效】清肺止咳，降逆止呕。枇杷叶则兼润肺燥，善治燥咳；又能和胃降逆（C错）止呕，治胃热呕吐。川贝母：【功效】清热化痰，润肺止咳，散结消痈（D错）。